下列各项，不属心搏呼吸骤停临床表现的是
A. 突然昏迷
B. 大动脉搏动消失
C. 心音消失
D. 瞳孔缩小
E. 呼吸停止或严重呼吸困难

正确答案：D。瞳孔缩小

解析：心搏呼吸骤停临床表现：突然昏迷（A对），大动脉搏动消失（B对），心音消失（C对）或心跳过缓，瞳孔扩大，呼吸停止或严重呼吸困难（E对）。心脏停搏30～40秒瞳孔开始扩大，对光反射消失。瞳孔大小可反映脑细胞功能受损程度，而瞳孔缩小常见于虹膜炎、有机磷农药中毒及吗啡等药物的影响（D错，为本题正确答案）。